某疾病的自身抗原是髓磷脂碱性蛋白（MPB），自身反应性T细胞起主要作用，利用MPB可以制备动物的模型，该疾病是
A. SLE
B. 类风湿性关节炎
C. 糖尿病
D. 多发性硬化症
E. 桥本甲状腺炎

正确答案：D。多发性硬化症